以下关于涎腺肿瘤的叙述，哪项是错误的
A. 黏液表皮样癌分为高、低两种分化程度
B. 腺淋巴瘤多见于老年男性，好发于腮腺后下极，可有消长史
C. 黏液表皮样癌好发于小涎腺
D. 腺样囊性癌侵袭性强，常出现疼痛和神经麻痹
E. 腮腺恶性肿瘤如术中见面神经穿过瘤体时应考虑切除面神经

正确答案：C。黏液表皮样癌好发于小涎腺

解析：黏液表皮样癌患者女性多于男性，发生于腮腺者居多，其次是腭部和下颌下腺，也可发生于其他小唾液腺，特别是磨牙后腺。掌握“黏液表皮样癌”知识点。